不属于被动吸烟危害范畴的是
A. 母亲吸烟对胎儿的影响
B. 与口腔、喉、食管癌的发病密切相关
C. 对成年人的影响
D. 可增加肺癌的危险
E. 家长吸烟对儿童的影响

正确答案：B。与口腔、喉、食管癌的发病密切相关